下列哪项不是喘证的成因
A. 外邪侵袭
B. 肺气虚冷
C. 饮食不当
D. 劳欲久病
E. 情志失调

正确答案：E。情志失调

解析：慢性支气管炎属于中医喘证、咳嗽范畴。外邪侵袭，肺失宣降，痰湿阻肺，故引起咳喘（A对）。肺气虚冷，清肃无权，气不化津，形成痰湿阻肺（B对）。脾为生痰之源，痰湿上渍于肺，肺失宣降（C对）。劳欲久病，必伤于阴，肺失滋润，故致咳喘（D对）。情志失调与咳喘的成因关系不密切（E错，为本题正确答案）。